患儿，5岁。发热3天，体温40℃，面赤，咽喉肿痛腐烂，全身皮疹密布，色紫红，舌面光红，脉数有力。治疗应首选
A. 宣毒发表汤
B. 普济消毒饮
C. 黄连解毒汤
D. 凉营清气汤
E. 犀角地黄汤

正确答案：D。凉营清气汤

解析：患儿咽喉肿痛腐烂，全身皮疹密布，色紫红，当属猩红热。高热，咽喉肿痛腐烂，全身皮疹密布，色紫红诊断为毒炽气营证。治以凉营清气汤，可清气凉营，泻火解毒（D对）。宣毒发表汤适于麻疹初期，症见发热、咳嗽、鼻塞流涕、泪水注汪、畏光羞明（A错）。普及消毒饮适于热毒壅盛的流行性腮腺炎，症见耳下腮部肿痛，坚硬拒按，张口咀嚼困难，高热头痛（B错）。黄连解毒汤善治三焦火热证，症见大热烦渴，或热病吐血、衄血，或热甚发斑，外科痈疽疔毒，舌红苔黄（C错）。犀角地黄汤主治热入血分证，症见血热妄行吐衄斑，蓄血发狂，舌质绛（E错）。